实验性研究是以人为研究对象，故须慎重考虑
A. 研究对象的职业
B. 研究对象的性别
C. 研究对象的样本量
D. 医德问题
E. 研究工作的持续时间

正确答案：D。医德问题